固定桥最重要的支持基础
A. 牙骨质
B. 牙周膜
C. 牙根
D. 结合上皮
E. 黏骨膜

正确答案：B。牙周膜

解析：本题考查固定桥的生理基础。固定桥最重要的支持基础为牙周膜（B对）。牙周膜面积与牙根的长短、数目和形态有关，牙根长而粗大或多根牙，则牙周膜面积大，其支持能力也大。